对于先天性肥厚性幽门狭窄叙述错误的是
A. 症状出现在生后2～4周
B. 呕吐是主要症状
C. 在喂奶后可见到膨胀胃的蠕动波，波形出现于右肋下缘到脐的左上方消失
D. 80%可以摸到幽门肿块
E. 体重起初不增，继而迅速下降

正确答案：C。在喂奶后可见到膨胀胃的蠕动波，波形出现于右肋下缘到脐的左上方消失

解析：先天性肥厚性幽门狭窄是由于幽门环肌增生肥厚，使幽门管腔狭窄而引起的上消化道不完全梗阻性疾病。胃蠕动波从左季肋下向右上腹部移动，到幽门即消失（C错，为本题正确答案）。症状出现在生后2-4周，极少发生于出生4个月之后（A对）。呕吐是主要症状，最初仅是吐奶接着是喷射性呕吐（B对）。80%可以摸到幽门肿块（D对）。体重起初不增，继而迅速下降。日渐消瘦，出现营养不良和失水（E对）。